儿童容易肾积水的原因
A. 肾盂输尿管连接处狭窄
B. 输尿管膀胱连接处狭窄
C. 髂血管压迫输尿管
D. 肾盂发育不全
E. 结石

正确答案：A。肾盂输尿管连接处狭窄

解析：儿童输尿管长而弯曲，管壁肌肉和弹力纤维发育不良，容易受压及扭曲而导致梗阻，尤其是肾盂输尿管连接处的狭窄，是儿童肾积水的常见病因（A对）。